男，82岁，阵发心悸两年，再发一小时，P108次/分，心率不齐，S1强弱不等，无明显杂音，心电图无P波代之以f波，心室率150次/分，R-R不等，应诊断为
A. 房性心动过速
B. 阵发性室上性心动过速
C. 房颤
D. 房扑
E. 室速

正确答案：C。房颤

解析：患者男，82岁，阵发心悸两年，再发一小时，P108次/分，心律不齐，S1强弱不等，无明显杂音，心电图无P波代之以f波，心室率150次/分，R-R不等，结合患者的表现，应诊断为心房颤动（C对）。（